在治疗冠心病方面与硝酸甘油有同样疗效的是
A. 胆酸
B. 别胆酸
C. 牛磺酸
D. 甘氨酸
E. 麝香酮

正确答案：E。麝香酮

解析：本题考查的是麝香的化学成分。在治疗冠心病方面与硝酸甘油有同样疗效的是麝香酮（E对）。麝香的化学成分较为复杂，其中麝香酮（L-3-甲基十五环酮）是天然麝香的有效成分之一，使麝香具有特有的香气，对冠心病有与硝酸甘油同样的疗效，而且副作用小。《中国药典》以麝香酮为指标成分进行含量测定，要求麝香酮含量不得少于2.0%。此外，麝香中还含有降麝香酮，麝香吡啶和羟基麝香吡啶A、B等10余种雄甾烷衍生物，而且还有多肽、脂肪酸、胆甾醇及其酯和蜡等。胆酸（A错）与别胆酸（B错）属于胆汁酸、牛磺酸（C错）与甘氨酸（D错）属于氨基酸，均不用于治疗冠心病。